面色白，畏寒肢冷，喜静，小便清长，下利清谷，属于
A. 阳偏衰
B. 阴偏衰
C. 阴阳互损
D. 阴寒偏盛
E. 热盛伤阴

正确答案：A。阳偏衰

解析：本题考查的是阴阳失调的临床表现。面色白，畏寒肢冷，喜静，小便清长，下利清谷，属于阳偏衰（A对）。阳虚：又称“阳偏衰”，是指机体阳气虚损、功能减退或衰弱、热量不足的病机变化。阳虚则寒，不但可见到面色白、畏寒肢冷、舌淡、脉迟等寒象，而且还有喜静踡卧、小便清长、下利清谷等虚象。阴偏衰（B错），即阴虚。阴虚：又称“阴偏衰”，是指机体精、血、津液等物质亏耗，以及阴不制阳，导致阳相对亢盛、功能虚性亢奋的病机变化。五心烦热、骨蒸潮热、颧红消瘦、盗汗、咽干口燥、舌红少苔、脉细数无力等，即是阴虚则热的表现。阴阳互损（C错），是指阴或阳任何一方虚损到相当程度，病变发展影响及相对的一方，形成阴阳两虚的病变机制。阴寒偏盛（D错），即阴盛格阳。阴盛格阳，是指阴寒之邪壅盛于内，逼迫阳气浮越于外，使阴阳之气不相顺接、相互格拒，表现为真寒假热的病机变化。病变本质是阴寒内盛，临床可见四肢厥逆、下利清谷、脉微欲绝等症状；又可见阳浮于外，症见身热反不恶寒（但欲盖衣被）、面颊泛红等假热之象。热盛伤阴（E错），即阳盛格阴。阳盛格阴，是指邪热过盛，深伏于里，阳气被遏，郁闭于内，不能外透布达于肢体，从而形成阴阳排斥，而格阴于外，表现为真热假寒的病机变化。病变本质是阳热内盛，临床可见身热、面红、气粗、烦躁等症状；又突然出现四肢厥冷（但身热不恶寒）、脉象沉伏（但沉数有力）等假寒之象。